继发腭的出现时间为
A. 胚胎第3周
B. 胚胎第4周
C. 胚胎第5周
D. 胚胎第6周
E. 胚胎第7周

正确答案：E。胚胎第7周

解析：本题考查腭部与舌的发育。胚胎第7周时，从左右两个上颌突的口腔侧中部向原始口腔内各长出一个突起，称为侧腭突或继发腭。